根据《中华人民共和国药品管理法实施条例》，可以委托生产的药品包括
A. 维C银翘片
B. 人血白蛋白
C. 狂犬疫苗
D. 板蓝根冲剂
E. 维生素胶囊

正确答案：A、D、E。维C银翘片；板蓝根冲剂；维生素胶囊

解析：本题考查的是药品委托生产管理。根据《中华人民共和国药品管理法实施条例》，可以委托生产的药品包括维C银翘片（A对）、板蓝根冲剂（D对）、维生素胶囊（E对）。依法自行生产或委托生产药品：上市许可持有人自行生产药品的，应当依照《药品管理法》规定取得药品生产许可证；委托生产的，应当委托符合条件的药品生产企业。药品上市许可持有人和受托生产企业应当签订委托协议和质量协议，并严格履行协议约定的义务。血液制品、麻醉药品、精神药品、医疗用毒性药品、药品类易制毒化学品不得委托生产；但是，国务院药品监督管理部门另有规定的除外。血液制品，是特指各种人血浆蛋白制品，包括人血白蛋白（A错）、人胎盘血白蛋白、静脉注射用人免疫球蛋白、肌注人免疫球蛋白、组织胺人免疫球蛋白、特异性免疫球蛋白、免疫球蛋白（乙型肝炎、狂犬病（C错）、破伤风免疫球蛋白）、人凝血因子Ⅷ、人凝血酶原复合物、人纤维蛋白原、抗人淋巴细胞免疫球蛋白等。